用于室性心动过速的药物是
A. 地高辛
B. 奎尼丁
C. 两者皆有效
D. 两者皆无效

正确答案：B。奎尼丁

解析：本题考查用于室性心动过速的药物。奎尼丁（B对）为Ⅰa类钠通道阻滞剂，临床用于心房颤动、心房扑动，室上性及室性心动过速的治疗。地高辛为强心苷类正性肌力药，临床主要用于急、慢性心力衰竭（A错）。